支配第3—4蚓状肌的神经是
A. 桡神经深支
B. 肌皮神经
C. 桡神经浅支
D. 正中神经
E. 尺神经

正确答案：E。尺神经

解析：桡神经深支（A错）支分布于前臂伸肌群、桡尺远侧关节、腕关节和掌骨间关。肌皮神经（B错）支配喙肱肌、肱二头肌和肱肌。桡神经浅支（C错）为皮支，分布于手背桡侧半皮肤和桡侧两个半手指近节背面的皮肤。正中神经（D错）运动纤维支配第1、2蚓状肌和鱼际肌（拇收肌除外），感觉纤维则分布于桡侧半手掌、桡侧三个半手指掌面皮肤及其中节和远节指背皮肤。尺神经（E对）深支分布于小鱼际肌、拇收肌、骨间掌侧肌、骨间背侧肌及第3、4蚓状肌。